女性，48岁。突发右上腹剧烈绞痛，伴右肩背痛、恶心呕吐24小时。既往有类似发作。吃油脂食物后右上腹胀，嗳气。T39.8℃,P98次/分，BP140/90mmHg，无黄疸，可触及肿大胆囊，有明显腹膜刺激征，Murphy征阳性。最重要的治疗方法是
A. 大剂量抗生素
B. 对症治疗
C. 禁食，输液
D. 胆囊切除术
E. 中药治疗

正确答案：D。胆囊切除术

解析：中年女性患者，既往吃油脂食物后右上腹胀，嗳气，突发右上腹剧烈绞痛（胆囊炎的典型症状），伴右肩背痛、恶心呕吐24小时，T39.8℃（正常值为36℃～37℃，提示发热），P98次/分（正常值为60～100次/分），BP140/90mmHg（正常值为90～140/60～90mm/Hg），无黄疸，可触及肿大胆囊，有明显腹膜刺激征（提示弥漫性腹膜炎），Murphy征阳性（提示胆囊炎），根据患者的病史、临床症状及体征考虑，最可能的诊断为急性化脓性胆囊炎，且发病时间<72小时，所以应行急诊手术，因而该患者最重要的治疗方法是胆囊切除术（D对），大剂量抗生素（A错）、对症治疗（B错）、禁食，输液（C错）属于一般治疗，适用于急性单纯性胆囊炎有缓解趋势着。中药治疗（E错）较少应用。